以下桂枝茯苓丸的主治病证的是
A. 产后恶露不尽
B. 癥瘕
C. 乳痈
D. 闭经
E. 经行腹痛

正确答案：A、B、D、E。产后恶露不尽；癥瘕；闭经；经行腹痛

解析：本题考查的是桂枝茯苓丸的主治。以下桂枝茯苓丸的主治病证的是产后恶露不尽（A对）、癥瘕（B对）、闭经（D对）与经行腹痛（E对）。桂枝茯苓丸：【主治】妇人素有癥块，或血瘀经闭，行经腹痛，以及产后恶露不尽等。乳癖消胶囊：【主治】痰热互结所致的乳癖、乳痈（C错），症见乳房结节、数目不等、大小形态不一、质地柔软，或产后乳房结块、红热疼痛；乳腺增生、乳腺炎早期见上述证候者。